适宜卡介苗接种的主要对象是
A. 结核性脑膜炎
B. 结核菌素试验阳性者
C. 严重的结核病患者
D. 新生儿及结核菌素试验阴性的儿童
E. 细胞免疫功能低下者

正确答案：D。新生儿及结核菌素试验阴性的儿童

解析：疫苗是接种后能使机体对特定疾病产生免疫力的生物制剂，主要用于疾病的预防。卡介苗的主要作用是预防肺结核，预防作用最好是在疾病感染前（ABC错）或对未感染的病人进行注射，主要接种对象是新生儿刚出生时、1月龄、6月龄及及结核菌素试验阴性的儿童（D对）。结核杆菌主要引起机体的细胞免疫，在细胞免疫功能低下者（E错），接种卡介苗，不能起到有效的疫苗保护作用。